硫酸奎宁需要检査的特殊杂质是
A. 麻黄碱
B. 罂粟碱
C. 莨菪碱
D. 阿扑吗啡
E. 其他金鸡纳碱

正确答案：E。其他金鸡纳碱

解析：本题考查喹啉类药物的有关物质。根据硫酸奎宁的制备工艺，产品中的有关物质主要是生产过程中产生的中间体以及副反应产物。通过检查酸度、三氯甲烷-乙醇中的不溶物质和其他金鸡纳碱（E对）等加以控制。莨菪碱（C错）是硫酸阿托品的特殊杂质。罂粟碱（B错）和阿扑吗啡（D错）是盐酸吗啡的特殊杂质。